给来访者以心理上的指导和帮助的过程，叫做
A. 心理评估
B. 心理诊断
C. 心理治疗
D. 心理支持
E. 心理咨询

正确答案：E。心理咨询